根据病情长短，感染可分为急性，亚急性和慢性感染，其中，急性感染的病程期限是
A. 6周内
B. 2周内
C. 4周内
D. 3周内
E. 1周内

正确答案：D。3周内

解析：本题考查急性感染。根据病情长短，感染可分为急性，亚急性和慢性感染，其中，急性感染的病程期限是3周内（D对）。急性感染的病程期限是3周之内。根据病程长短，外科感染可分为急性、亚急性与慢性感染。病程在3周之内为急性感染，超过2个月为慢性感染，介于两者之间为亚急性感染。感染亦可按照发生条件分类，如条件性（机会性）感染、二重感染（菌群交替）、医院内感染等。